《中华人民共和国刑法》规定，生产、销售假药，足以严重危害人体健康的，处以
A. 拘役，并处罚金
B. 三年以上十年以下有期徒刑，并处罚金
C. 死刑，并处罚金
D. 管制
E. 无期徒刑

正确答案：B。三年以上十年以下有期徒刑，并处罚金